五倍子的化学成分主要是
A. 没食子酸
B. 树脂
C. 鞣质
D. 脂肪
E. 蜡质

正确答案：C。鞣质